属于食品安全行政法规的是
A. 《中华人民共和国食品安全法》
B. 《国务院关于加强食品等产品安全监督管理的特别规定》
C. 《保健食品注册与备案管理办法》
D. 《北京市食品安全条例》
E. 《重庆市食品安全管理办法》

正确答案：B。《国务院关于加强食品等产品安全监督管理的特别规定》

解析：本题考查食品安全行政法规。食品安全行政法规由国务院制定，包括《国务院关于加强食品等产品安全监督管理的特别规定》（2007）（B对ACDE错）、《乳品质量安全监督管理条例》（2008）、《突发公共卫生事件应急条例》（2003）、《农业转基因生物安全管理条例》（2001）等。